预防佝偻病首选食物
A. 牛奶
B. 菠菜
C. 瘦肉
D. 大米
E. 胡萝卜

正确答案：A。牛奶